女，26岁。停经9周，阴道不规律流血2周，阴道检查无异常，子宫如孕4月大。超声示宫强内充满光点和小囊状强回声。最可能的诊断是
A. 葡萄胎
B. 绒癌
C. 双胎妊娠
D. 妊娠合并子宫肌瘤
E. 胎盘早剥

正确答案：A。葡萄胎

解析：患者为育龄期妇女，停经9周（疑为早孕），阴道不规则流血2周（葡萄胎患者一般在停经8～12周左右开始不规则阴道流血，量多少不定），妇检：子宫如4个月妊娠大小（因葡萄胎迅速增长及宫腔内出血，约半数以上患者的子宫大于停经月份），B超显示宫腔内充满光点和小囊状强回声（完全性葡萄胎的典型超声图像为子宫大于相应孕周，无妊娠囊或胎心搏动，宫腔内充满不均质密集状或短条状回声，呈“落雪状”，水泡较大时则呈“蜂窝状”），首先考虑为葡萄胎（A对）。双胎妊娠（C错）和妊娠合并子宫肌瘤（D错），妊娠早期无阴道不规则流血，B超检查无“落雪征”，而且前者B超可见宫腔内两个妊娠囊，后者B超可明确肌瘤的大小、位置、数目。胎盘早剥（E错）多发生于妊娠晚期，孕妇常腹痛，B超可直接明确诊断。绒毛膜癌（B错）大体观见肿瘤侵入子宫肌层，与周围组织分界清，伴明显出血坏死。镜下见细胞滋养细胞和合体滋养细胞成片状高度增生，明显异型，不形成绒毛或水泡状结构。